用生存时间评价筛查效果时，可能会产生的偏倚是
A. 领先时间偏倚
B. 病程长短偏倚
C. 回忆偏倚
D. 过度诊断偏倚
E. 志愿者偏倚

正确答案：A。领先时间偏倚

解析：本题考查领先时间偏倚。生存时间是确诊到因病死亡的那段时间，如果筛检则可使确诊时间提前，此时筛检组确诊的时间和对照组确诊的时间之差属于领先时间，用生存时间评价筛查效果时，可能会产生的偏倚是领先时间偏倚（A对BCDE错）。